与语言，呼吸，心搏强弱有关的气是
A. 卫气
B. 宗气
C. 营气
D. 中气
E. 元气

正确答案：B。宗气

解析：本题考查宗气的生理功能。宗气的生理功能主要有行呼吸、行血气和资先天三个方面。宗气可以推动肺的呼吸，因此呼吸、语言、发声皆与宗气有关。宗气充盛 则呼吸徐缓而均匀，语言清晰，声音洪亮。反之，则呼吸短促微弱，语言不清，发声低微。宗气行气血，因此，凡血液的运行、心搏的力量及节 律等皆与宗气有关”（B对）。卫气有防御外邪、温养全身和调控腠理的生理功能（A错）。营气的生理功能有化生血液和营养全身（C错）。中气是脾胃二气的合称，生理功能主要指对事物的饮食的消化运输、升清降浊（D错）。元气的生理功能一是推动和调节人体的生长发育和 生殖机能；二是推动和调控各脏腑、经络、形体、官窍的生理活动（E错）。